全层头皮撕脱伤下列哪项处理不正确
A. 妥善止血
B. 尽早清创
C. 防治休克
D. 抗感染
E. 中厚皮片植皮

正确答案：E。中厚皮片植皮

解析：本题考查全层头皮撕脱伤的处理。全层头皮撕脱伤处理不正确的是中厚皮片植皮（E错，为本题的正确答案）。全层头皮撕脱伤是指头皮自帽状腱膜下撕脱，有时整个头皮甚至额肌、颞肌、骨膜一起撕脱，颅骨外露。此类损伤特点是出血量大，常伴有休克，易感染，治疗不及时可危及生命或致颅骨感染坏死。故应妥善止血（A对），防止休克（C对），尽早清创（B对），全身使用有效的抗生素预防感染治疗（D对）。大面积头皮缺损、伴颅骨与硬脑膜缺损者，清创时需修补硬脑膜与头皮。也有用带血管蒂的大网膜复盖创面，同时一期植皮或待肉芽生长后再植皮。